患者，女，22岁，恶寒，高热，咳嗽，胸痛1天入院。检查：血压85/50mmHg（11.4/6kPa），脉搏100/分，X线胸片示右上肺大片片状阴影，呈肺段分布，白细胞21x10⁹/L。其诊断是
A. 休克型肺炎
B. 病毒性肺炎
C. 支原体肺炎
D. 肺炎球菌肺炎
E. 肺脓肿

正确答案：D。肺炎球菌肺炎

解析：肺炎球菌肺炎（D对）多起病急骤，高热、寒战，全身肌肉酸痛，体温通常在数小时内升至39℃～40℃，高峰在下午或傍晚，或呈稽留热，脉率随之增加。可有患侧胸部疼痛，放射到肩部或腹部，咳嗽或深呼吸时加剧。X线早期仅见肺纹理增粗，或受累的肺段、肺叶稍模糊。随着病情进展，肺泡内充满炎性渗出物，表现为大片炎症浸润阴影或实变影，血白细胞计数（10～20）×l0⁹/L。休克型肺炎（A错）常有休克表现。病毒性肺炎（B错）多发于病毒流行季节，临床症状较轻，初起见上呼吸道症状，阵发性咳嗽，或少量白色黏痰，伴胸痛、气喘、持续发热，体征多不明显。支原体肺炎（C错）多伴咽炎、支气管炎等呼吸道感染，起病缓，发热无定型，可有畏寒，但无寒战，持久的阵发性刺激性呛咳为本病的突出症状。肺脓肿（E错）特点为咳吐大量腥臭脓痰。